随胆汁排出的药物或代谢物，经体循环重新回到门静脉的现象为
A. 零级代谢
B. 首过效应
C. 被动扩散
D. 肾小管重吸收
E. 肠肝循环

正确答案：E。肠肝循环

解析：本题考查肝肠循环。肠肝循环（E对）是指随胆汁排入十二指肠的药物或其代谢物，在肠道中重新被吸收，经门静脉返回肝脏，重新进入血液循环的现象；零级动力学（A错）是指单位时间内吸收或消除药量保持不变；首过效应（B错）是指某些经胃肠道吸收的药物在进入血液之前被代谢而使进入血液循环的原形药量减少的现象；被动扩散（C错）是顺浓度梯度的转运过程，不消耗能量；肾小管重吸收（D错）是指肾小管上皮细胞将小管液中的水分和某些溶质，部分地或全部地转运到血液的过程。